以下避孕方法，哪项失败率低，并能减少STD传播
A. IUD
B. 安全期
C. 避孕套
D. 阴道隔膜
E. 口服避孕药

正确答案：C。避孕套